能够反映食品腐败变质的化学指标是
A. 浸出物量
B. 酸价
C. 折光率
D. 冰点
E. 黏度

正确答案：B。酸价

解析：本题考查能够反映食品腐败变质的化学指标。食品腐败变质的鉴定一般采用感官、物理、化学和微生物四个方面的指标。能够反映食品腐败变质的化学指标是酸价（B对）。浸出物量（A错）、折光率（C错）、冰点（D错）、黏度（E错）是反映食品腐败变质的物理指标。